发育迟缓的病因是
A. 体质性延迟
B. 低促性腺激素性腺功能延迟
C. 高促性腺激素性腺功能减退
D. 中枢神经系统或卵巢肿瘤者
E. 以上均是

正确答案：E。以上均是

解析：本题考查发育迟缓的病因。发育迟缓又称为生长发育迟缓，胎儿或子代生长发育指标比正常对照低2个标准差。大部分发育迟缓的病因为体质性延迟、低促性腺激素性腺功能延迟、高促性腺激素性腺功能减退、中枢神经系统或卵巢肿瘤者（E对ABCD错）。